队列研究中研究对象应选择
A. 在患某病者中选择有、无某暴露因素的两个组
B. 在患该病者中选择有某暴露因素的为一组，在无该病者中选择无该暴露因素的为另一组
C. 在无该病者中选择有某暴露因素的为一组，在有该病者中选择无该暴露因素的为另一组
D. 在无该病者中，选择有、无某暴露因素的两个组
E. 任选有无暴露的两个组

正确答案：D。在无该病者中，选择有、无某暴露因素的两个组

解析：本题考查队列研究中研究对象的选择。队列研究是将人群按是否暴露于某可疑因素及其暴露程度分为不同组，追踪其各组的结局，比较不同组之间结局频率的差异，从而判定暴露因素与结局之间有无因果关联及关联大小的一种观察性研究方法。其研究对象应在无该病者中，选择有、无某暴露因素的两个组（D对ABCE错）。